根据《药品管理法》的规定，以下品种不属于药品的是
A. 血清
B. 疫苗
C. 农药
D. 原料药
E. 血液制品

正确答案：C。农药

解析：药品的法定范围包括“中药材、中药饮片、中成药、化学原料药及其制剂、抗生素、生化药品、放射性药品、血清、疫苗、血液制品和诊断药品等”。药品特指人用药品，不包括兽药和农药。掌握“药品管理及法律责任”知识点。